患者，女，78岁。因患高血压病长期口服硝苯地平控释片（规格为30mg·hg·hg），后续又出现头晕、恶心、心悸、胸闷，随后就医。关于口服缓释、控释制剂的临床应用与注意事项的说法，错误的是
A. 控释制剂的药物释放速度恒定，偶尔过量服用不会影响血药浓度
B. 缓释制剂用药次数过多或增加给药剂量可导致血药浓度增高
C. 部分缓释制剂的药物释放速度由制剂表面的包衣膜决定
D. 控释制剂的服药间隔时间通常为12小时或24小时
E. 缓释制剂用药次数不够会导致药物的血药浓度过低，达不到应有的疗效

正确答案：A。控释制剂的药物释放速度恒定，偶尔过量服用不会影响血药浓度

解析：本题考查临床中使用缓释、控释制剂的注意事项。控释制剂的药物释放速度恒定，偶尔过量服用不会影响血药浓度（A错，为本题正确答案）。患者使用控释制剂的药物时不能随意增加剂量，否则血药浓度太高会增加毒性反应。口服缓释、控释制剂的服药间隔时间一般为12小时或24小时（D对）。为维持有效血药浓度，避免或减少不良反应的发生，患者应注意不要漏服，以免血药浓度过低不能控制症状（E对），也不要随意增加剂量，否则血药浓度太高会增加毒性反应（B对），服药时间必须一致。部分缓控释制剂的药物释放速度和释放部位是由制剂表面或夹层的包衣膜控制，如膜控型、定位型释放片，只有保持膜的完整性才能使药物按设定的速度和部位释放达到缓控释的目的（C对）。